京万红适用于
A. 四肢麻木
B. 关节痛
C. 皮肤瘙痒
D. 轻度水、火烫伤
E. 伤风感冒引起的头痛

正确答案：D。轻度水、火烫伤

解析：本题考查的是京万红软膏的主治。京万红适用于轻度水、火烫伤（D对）。京万红软膏：【主治】轻度水、火烫伤，疮疡肿痛，创面溃烂。茜草：【主治病证】（1）吐血，衄血，崩漏，尿血，便血等。（2）闭经，痛经，跌打肿痛，痹证关节痛（B错）。消风止痒颗粒：【主治】风湿热邪蕴阻肌肤所致的湿疮、风疹瘙痒、小儿瘾疹，症见皮肤丘疹、水疱、抓痕、血痂、或见梭形或纺锤形水肿性风团、中央出现小水疱、瘙痒剧烈（C错）；湿疹、皮肤瘙痒症、丘疹性荨麻疹见上述证侯者。主治为四肢麻木（A错）或伤风感冒引起的头痛（E错）的中成药，2022年考试指南未明确说明。